男性，19岁，肉眼血尿伴尿量减少一天，2周前有上呼吸道感染史，查体：血压160/90mmHg，眼睑及双下肢水肿，尿常规：尿蛋白（++），RBC10～15/HP，WBC5～10×10⁹/L，血常规C3降低。最可能的诊断是
A. 急性肾小球肾炎
B. 急进性肾小球肾炎
C. 膜增生性肾小球肾炎
D. 微小病变型肾病
E. 肾病综合征

正确答案：A。急性肾小球肾炎

解析：该患者男性，19岁（急性肾小球肾炎多见于男性儿童），肉眼血尿伴尿量减少一天，2周前有上呼吸道感染史（链球菌感染史，急性肾小球肾炎的病因），查体：血压160/90mmHg，眼睑及双下肢水肿，尿常规：尿蛋白（++）（急性肾小球肾炎的表现），RBC10～15/HP，WBC5～10×10⁹/L，血常规C3降低，符合肾小球肾炎的特点，最可能的诊断是急性肾小球肾炎（A对）。